患者，女，56岁，身高156cm，体重61kg。空血糖7.8mmol/L，餐后血糖11.2mmol/L，糖化血红蛋白6.7%。关于该患者初始治疗，宜采用的方案是
A. 饮食及运动治疗
B. 口服二甲双胍
C. 口服磺酰脲类降糖药
D. 口服α-葡萄糖苷酶抑制剂
E. 皮下注射胰岛素

正确答案：B。口服二甲双胍

解析：本题考查二甲双胍。该患者初始治疗，宜采用的方案是口服二甲双胍（B对）。该患者身高156cm，体重61kg，BIM为25，属于超重，首选二甲双胍。在饮食控制和运动干预（A错）仍不能使血糖控制达标时，须及时应用降糖药物治疗。不耐受二甲双胍的治疗者， 可选择促胰岛素分泌剂（包括磺酰脲类药物（C错）和格列奈类药物）或α- 葡萄糖苷酶抑制剂（D错）。1型糖尿病患者需依赖胰岛素（E错）维持生命，也必须使用胰岛素控制高血糖，并降低糖尿病并发症的发生风险。